能发生起昙现象的表面活性剂是
A. 脂肪酸山梨坦
B. 十二烷基硫酸钠
C. 卵磷脂
D. 聚山梨酯
E. 硬脂酸钠

正确答案：D。聚山梨酯